利用溶出原理达到缓（控）释目的方法是
A. 包衣
B. 制成微囊
C. 制成不溶性骨架片
D. 将药物包藏于亲水性高分子材料中
E. 制成药树脂

正确答案：D。将药物包藏于亲水性高分子材料中

解析：本题考查缓（控）释制剂。利用溶出原理达到缓（控）释目的方法是将药物包藏于亲水性高分子材料中（D对）。缓释、控释制剂的释药原理包括溶出原理、扩散原理、溶蚀与扩散结合的原理、渗透压原理、离子交换作用。利用溶出原理达到缓（控）释目的方法有制成溶解度小的盐或酯、制成药物-高分子化合物难溶性盐、控制粒子大小。利用扩散原理达到缓（控）释目的方法有包衣（A错）、微囊化（B错）、制成不溶性的骨架片（C错）、制成植入剂、制成经皮吸收制剂、增加黏度以减小扩散速度。利用离子交换作用达到缓（控）释目的方法有制成药树脂（E错）等。